男孩，4岁，1小时前摔倒后右肩部疼痛。查体：头向右侧偏斜，右肩下沉，右侧上肢活动障碍，Dugas征阴性。最可能的诊断是
A. 锁骨骨折
B. 正中神经损伤
C. 桡骨头半脱位
D. 肘关节脱位
E. 肩关节脱位

正确答案：A。锁骨骨折

解析：4岁男孩，右肩摔伤、头向右侧偏斜、右肩下沉（锁骨骨折典型表现），结合患者病史、临床表现和体查，其最可能的诊断是锁骨骨折（A对）。正中神经（P700）（B错）腕部损伤表现为拇指对掌功能障碍、手的桡侧半感觉障碍和“猿手”畸形，肘上损伤时，除上述症状，还伴有拇指、示、中指屈曲功能障碍。桡骨头半脱位（P638）（C错）多发生在5岁以下小儿，腕、手有被向上牵拉的受伤史，患儿感肘部疼痛，活动受限，前臂处于半曲位及旋前位。肘关节脱位（P637）（D错）典型表现为肘后三角关系改变，肘后突畸形。肩关节脱位（P631）（E错）典型表现为方肩畸形，Dugas征阳性（即将患侧肘部紧贴胸壁时，手掌搭不到健侧肩部，或手掌搭在健侧肩部时，肘部无法贴近胸壁）。